国家规定与艾滋病检测相关的制度是
A. 义务检测
B. 强制检测
C. 有关检测
D. 自愿检测
E. 定期检测

正确答案：D。自愿检测

解析：国家建立健全艾滋病监测网络，实行艾滋病自愿咨询和自愿检测制度（D对）。